制备解离组织片常用的解离试剂有
A. 水合氯醛试液
B. 5%氢氧化钾溶液
C. 甘油-醋酸试液
D. 硝铬酸试液
E. 硝酸溶液（1→2）及氯酸钾

正确答案：B、D、E。5%氢氧化钾溶液；硝铬酸试液；硝酸溶液（1→2）及氯酸钾

解析：本题考查的是解离组织片。制备解离组织片常用的解离试剂有5%氢氧化钾溶液（B对）、硝铬酸试液（D对）、硝酸溶液（1→2）及氯酸钾（E对）。解离组织片，如需观察细胞的完整形态，尤其是纤维、导管、管胞、石细胞等细胞彼此不易分离的组织，需利用化学试剂使组织中各细胞之间的细胞间质溶解，使细胞分离。如样品中薄壁组织占大部分，木化组织少或分散存在的，可用氢氧化钾法；如样品坚硬，木化组织较多或集成群束的，可用硝铬酸法或氯酸钾法。